毛细管电泳法常用的分离模式有
A. 毛细管区电泳
B. 毛细管凝胶电泳
C. 薄层色谱
D. 纸电泳
E. 毛细管气相色谱

正确答案：A、B。毛细管区电泳；毛细管凝胶电泳

解析：本题考查毛细电泳法的分离模式。毛细管电泳法的分离模式主要有：毛细管区带电泳（A对）、毛细管等速电泳、毛细管等电聚焦、毛细管电色谱、胶束电动毛细管色谱、毛细管凝胶色谱（B对）。